下列哪项不是限制性内切酶识别序列的特点
A. 特异性很高
B. 常由4~6个核苷酸组成
C. 一般具有回文结构
D. 少数内切酶识别序列中的碱基可以有规律地替换
E. 限制性内切酶的切口均是黏性末端

正确答案：E。限制性内切酶的切口均是黏性末端